苯的沸点80.1℃，在常温下容易挥发，形成较大的蒸气压，易经呼吸道吸收
A. 脂/水分配系数与毒效应
B. 电离度与毒效应
C. 挥发度和蒸气压与毒效应
D. 绝对毒性和相对毒性与毒效应
E. 分散度与毒效应

正确答案：C。挥发度和蒸气压与毒效应

解析：本题考查挥发度和蒸气压与毒效应。苯的沸点80.1℃，在常温下容易挥发，形成较大的蒸气压，易经呼吸道吸收，说明了挥发度和蒸气压与毒效应的关系（C对ABDE错）。